用补血法治疗产后血虚便秘，属于
A. 热因热用
B. 通因通用
C. 塞因塞用
D. 寒者热之
E. 热者寒之

正确答案：C。塞因塞用